产后气血虚弱，乳汁少甚或全无，治疗可选
A. 通乳丹
B. 八珍汤
C. 逍遥散
D. 下乳涌泉散
E. 归脾汤

正确答案：A。通乳丹

解析：气血虚弱,乳汁化源不足,无乳可下,故乳少或全无,乳汁清稀，治宜补气养血，佐以通乳。方药可用通乳丹（A对）。